进入肠肝循环的药物的来源部位是
A. 肝脏
B. 肾脏
C. 肺
D. 胆
E. 心脏

正确答案：D。胆

解析：本题考查肝肠循环。进入肠肝循环的药物来源部位是胆（D对）。经胆汁排入肠腔的药物部分可再经小肠上皮细胞吸收经肝脏进入血液循环，这种肝脏、胆汁、小肠间的循环称为肠肝循环。